包皮环切术时，应避免损伤
A. 阴茎包皮
B. 海绵体
C. 包皮系带
D. 阴茎筋膜
E. 阴囊

正确答案：C。包皮系带

解析：包皮系带（C对）为包皮与阴茎头腹侧中线处连着的一条皮肤皱襞，作包皮环切术时应避免损伤，以免影响阴茎的勃起。